某工人员郑某，施工中遭受外力重击，需要给予输血治疗，根据《临床输血技术规范》规定，经治医师向他说明输同种异体血的不良反应和经血传播疾病的可能性后，他应签署的法律文书是
A. 临床输血申请单
B. 输血治疗同意书
C. 交叉配血报告单
D. 输血反应回报单
E. 同型输血认可书

正确答案：B。输血治疗同意书

解析：本题考查临床用血管理。某工人员郑某，施工中遭受外力重击，需要给予输血治疗，根据（《临床输血技术规范》规定，经治医师向他说明输同种异体血的不良反应和经血传播疾病的可能性后，他应签署的法律文书是输血治疗同意书（B对）。临床输血申请单（A错）是在临床用血申请制度中，由具有中级以上专业技术职务任职资格提出输血申请，上级医师核准签发后，方可备血。交叉配血报告单（C错）是医疗机构为核对受血者和供血者是否相合，所做的交叉配血的结果报告单。输血反应回报单（D错）是患者输血后，医务人员观察患者输血后的反应所填写的文件。同型输血认可书（E错）是用于Rh（D）阴性血患者输血前所签署的文件。